过敏性休克采用
A. 糖皮质激素替代治疗法
B. 早期、大剂量、短期应用糖皮质激素
C. 抗菌药物与糖皮质激素合用
D. 抗结核病药与糖皮质激素合用
E. 糖皮质激素与肾上腺素合用

正确答案：E。糖皮质激素与肾上腺素合用

解析：本题考查过敏性休克的治疗。过敏性休克采用糖皮质激素与肾上腺素合用（E对）。对于过敏性休克，糖皮质激素为次选药，常与首选药肾上腺素合用，对心源性休克和低血容量性休克要结合病因进行治疗。糖皮质激素替代治疗法（A错）用于垂体前叶功能减退和慢性肾上腺皮质功能不全者。早期、大剂量、短期应用糖皮质激素（B错）用于严重中毒性感染及各种休克。抗菌药物与糖皮质激素合用（C错）用于急性细菌感染的治疗。抗结核病药与糖皮质激素合用（D错）一般用于结核病菌感染的患者。